下列属于无阈值化学物的是
A. 遗传毒性致癌物和体细胞致突变物
B. 遗传毒性致癌物和生殖细胞致突变物
C. 表观遗传毒性致癌物和体细胞致突变物
D. 表观遗传毒性致癌物和生殖细胞致突变物
E. 生殖细胞致突变物和体细胞致突变物

正确答案：B。遗传毒性致癌物和生殖细胞致突变物